余留牙重度磨耗导致咬合垂直距离过低，最适宜的修复方式为
A. 固定义齿
B. 可摘局部义齿
C. 覆盖可摘局部义齿
D. 活动桥
E. 即刻可摘局部义齿

正确答案：B。可摘局部义齿

解析：适用于余留牙重度磨耗等原因导致的咬合垂直距离过低，需恢复面部垂直距离者。掌握“局部义齿的适应证与禁忌证”知识点。